芦根不具有的功效是
A. 利尿
B. 排脓
C. 除烦止呕
D. 凉血止血
E. 清热生津

正确答案：D。凉血止血

解析：本题考查芦根的功效。芦根不具有的功效是凉血止血（D错，为本题正确答案）。芦根【功效】清热生津（E对），除烦止呕（C对），利尿（A对），排脓（B对）。